有关头静脉的描述，正确的是
A. 起自手背静脉网的尺侧
B. 在肘窝处位于深筋膜深面
C. 沿肱二头肌内侧沟上行
D. 延续为肱静脉
E. 在肘窝处通过肘正中静脉与贵要静脉交通

正确答案：E。在肘窝处通过肘正中静脉与贵要静脉交通

解析：头静脉起自手背静脉网的桡侧（A错）。头静脉在肘窝处（B错）通过肘正中静脉与贵要静脉交通（E对）。在肱二头肌外侧沟（C错）上行。延续为腋静脉或锁骨下静脉（D错）。